男，68岁。直肠指诊前列腺有一硬结。血清PSA10.5ng/ml。为明确诊断应采取的检查方法是
A. MRI
B. CT
C. 经直肠B型超声
D. 前列腺穿刺活组织检查
E. 放射性核素扫描

正确答案：D。前列腺穿刺活组织检查

解析：老年男性患者，直肠指诊前列腺有一硬结，血清PSA10.5ng/ml（血清正常PSA＜4.0ng/ml，提示前列腺癌的可能），结合患者体查和血清PSA，应首先考虑前列腺癌，为明确诊断，最可靠的检查方法为前列腺穿刺活组织检查（D对）。MRI（A错）虽可用于前列腺癌的诊断，但诊断价值不及穿刺活组织检查。CT（B错）主要用于显示肿瘤晚期周围组织的受累情况和盆腔肿大的淋巴结。经直肠B型超声（C错）可以显示前列腺内低回声病灶及其大小与侵及范围，主要用于辅助穿刺活检。放射性核素扫描（E错）主要用于早期发现前列腺癌的骨转移病灶。